下列各项，不属于内伤咳嗽的是
A. 痰热咳嗽
B. 痰湿咳嗽
C. 气虚咳嗽
D. 阴虚咳嗽
E. 风热咳嗽

正确答案：E。风热咳嗽

解析：咳嗽可分为外感、内伤两大类。内伤咳嗽为脏腑功能失调，内邪干肺，包括痰热咳嗽（A对）、痰湿咳嗽（B对）、气虚咳嗽（C对）、阴虚咳嗽（D对）四型，内伤咳嗽多为久病，常反复发作，病程长，多为虚实夹杂，本虚标实。外感咳嗽为六淫外邪侵袭肺系，包括风热咳嗽（E错，为本题正确答案）、风寒咳嗽、风燥咳嗽。